《素问·痹论》“肺痹”的症状是
A. 四支解堕，发咳呕汁
B. 中气喘争
C. 脉不通，烦则心下鼓
D. 夜卧则惊，多饮数小便
E. 烦满喘而呕

正确答案：E。烦满喘而呕

解析：凡痹之客五藏者，肺痹者，烦满喘而呕（E对）；心痹者，脉不通，烦则心下鼓，暴上气而喘，嗌干善噫，厥气上则恐（C错）；肝痹者，夜卧则惊，多饮数小便，上为引如怀（D错）；脾痹者，四支懈惰，发咳呕汁，上为大塞（A错）；肠痹者，数饮而出不得，中气喘争，时发飧泄（B错）。